枕先露时胎儿窘迫的诊断依据是
A. 破膜后羊水Ⅰ度污染
B. 胎动减弱
C. 胎心监护见到早期减速
D. 宫缩高峰时胎心110次/分
E. 胎儿头皮血pH值为7.18

正确答案：E。胎儿头皮血pH值为7.18

解析：胎儿头皮血pH值为7.18（＜7.20），可诊断为胎儿酸中毒，是胎儿窘迫的诊断依据（E对）。破膜后羊水I度污染不是胎儿窘迫的诊断依据（A错）。胎动在缺氧初期胎动频繁，继而减弱及次数减少，进而消失（B错）。胎儿窘迫缺氧早期，胎心监护可出现胎心极限代偿性加快、晚期减速（C错）或重度变异减速。宫缩高峰时胎心110次/分为正常情况（D错）。